取乳酸5.0g，加热水25ml溶解，放冷，加硝酸汞试液0.5m1，5分钟内不得生成絮状沉淀，这是检查
A. 氯化物
B. 溶液澄清度
C. 淀粉
D. 蛋白质类杂质
E. 溶液颜色

正确答案：D。蛋白质类杂质